肝素使用过量引起的出血应选用
A. 氢氯噻嗪
B. 头孢呋辛
C. 头孢他啶
D. 维生素K
E. 鱼精蛋白

正确答案：E。鱼精蛋白

解析：本题考查肝素使用过量引起出血的解救药物。肝素使用过量引起的出血应选用鱼精蛋白（E对）。氢氯噻嗪（A错）属于噻嗪类利尿剂，可用于各种原因引起的水肿、高血压病、肾性尿崩症等。头孢呋辛（B错）属于第二代头孢菌素，对G+菌作用作用略逊于第一代，对G-菌有明显作用，对厌氧菌有一定作用，但对铜绿假单胞菌及厌氧菌有较强的作用，对多种β- 内酰胺酶比较稳定，可用于治疗敏感菌所致肺炎、胆道感染、菌血症、尿路感染和其他组织器官感染等。头孢他啶（C错）属于第三代头孢菌素，对G+菌的作用不及第—、二代，对G-菌包括肠杆菌类铜绿假单胞菌及厌氧菌有较强的作用，对β-内酰胺酶有较高的稳定性，可用于危及生命的败血症、脑膜炎肺炎、骨髓炎及尿路严觅感染的治疗，能有效控制严重的铜绿假单胞菌感染。维生素K（D错）缓慢大剂量静脉注射可用于香豆素类药物（双香豆素、华法林等）用量过大引起出血的抢救。